木蝴蝶的别名是
A. 灸草
B. 白梅花
C. 淡大芸
D. 白故纸
E. 血见愁

正确答案：D。白故纸

解析：本题考查的是常见的饮片正名与相关别名。木蝴蝶的别名是白故纸（D对）。木蝴蝶别名：玉蝴蝶、千张纸、云故纸、白故纸。灸草（A错）为艾叶的别名。艾叶别名：祁艾、蕲艾、炙草、冰台。白梅花（B错）为中药的正名。淡大芸（C错）为肉苁蓉的别名。肉苁蓉别名：淡大芸。血见愁（E错）为茜草的别名。茜草别名：红茜草、茜草根、茜根、活血丹、血见愁、地血。